下列都是环境流行病学调查的基本内容，除外
A. 调查环境中已知有害因素是否已影响人群健康，并研究其流行病学特征
B. 调查人群中已知的健康危害是否与环境有关
C. 调查传染病的暴发特征
D. 考核环境改善后的效果
E. 研究环境污染物与人群健康的剂量反应关系

正确答案：C。调查传染病的暴发特征

解析：本题考查环境流行病学调查的基本内容。环境流行病学调查的基本内容包括：调查环境中已知有害因素是否已影响人群健康，并研究其流行病学特征（A对）；调查人群中已知的健康危害是否与环境有关（B对）；考核环境改善后的效果（D对）；研究环境污染物与人群健康的剂量反应关系（E对）。调查传染病的暴发特征（C错，为本题正确答案）不是环境流行病学调查的基本内容。